治疗焦虑症首选的药物是
A. 苯巴比妥
B. 异戊巴比妥
C. 酚妥拉明
D. 地西泮（安定）
E. 哌替啶

正确答案：D。地西泮（安定）